流脑皮肤瘀点瘀斑不断增加，考虑D1C，应及早应用的药物是
A. 青霉素
B. 甘露醇
C. 头孢菌素
D. 肾上腺皮质激素
E. 肝素

正确答案：E。肝素

解析：流行性脑脊髓膜炎如皮肤瘀斑、瘀点不断增加，且融合成片，并有血小板明显减少者，应及早应用肝素治疗（E对）。流行性脑脊髓膜炎可短期应用肾上腺皮质激素，减轻毒血症，稳定溶酶体，也可解痉，增强心肌收缩力及抑制血小板凝聚，有利于抗休克（D错）。